静脉滴注给药吸收速率较大的药-时曲线是
A. 曲线②
B. 曲线⑤
C. 曲线①
D. 曲线③
E. 曲线④

正确答案：A。曲线②

解析：本题考查单室模型静脉滴注。单室模型静脉滴注，在药物静脉滴注期间，体内药物的变化速率是药物进入体内的速率和从体内的消除速率这两部分的代数和，血药浓度在滴注期间随着滴注速度的增大而增大；停止滴注后，药物在体内只有一级消除过程，血药浓度随时间（t-T）成指数下降，如图②（A对）。